关于翼下颌间隙的描述中，正确的是
A. 前界为颞肌及颊肌，借颊肌与口腔分隔
B. 上界翼外肌下缘
C. 下以翼内肌附丽于下颌支处为界
D. 后为腮腺
E. 以上均正确

正确答案：E。以上均正确

解析：翼下颌间隙或称翼颌间隙，位于下颌支与翼内肌之间。前为颞肌及颊肌，借颊肌与口腔分隔，后为腮腺，上界翼外肌下缘，下以翼内肌附丽于下颌支处为界。掌握“面侧深区及颌面部各间隙的境界”知识点。